当风湿性心脏病二尖瓣狭窄程度加重时
A. 心尖部舒张期滚筒样杂音增强，肺动脉第二音减低
B. 心尖部舒张期滚筒样杂音减低，肺动脉第二音减低
C. 心尖部舒张期滚筒样杂音减低，肺动脉第二音增强
D. 心尖部舒张期滚筒样杂音增强，肺动脉第二音增强
E. 心尖部收缩期吹风样杂音和舒张期滚筒样杂音增强

正确答案：D。心尖部舒张期滚筒样杂音增强，肺动脉第二音增强

解析：二尖瓣狭窄时，心尖部可闻及舒张期滚筒样杂音，是血流通过瓣膜狭窄处时产生湍流而形成的，杂音强度随狭窄强度而增强（BC错）。二尖瓣狭窄时，左心房的血液经二尖瓣流入左心室受阻，使血液淤积于左心房，左心房压力升高，升高的左心房压被动向后传递至肺静脉、肺动脉，导致肺动脉压力增高，使第二心音的肺动脉瓣部分（P₂）亢进。肺动脉压越高，P₂越亢进（D对A错）。心尖部收缩期吹风样杂音（P292）（E错）见于二尖瓣关闭不全。